加速尚未吸收毒物的排泄应予
A. 针灸
B. 冲洗
C. 利尿
D. 洗胃
E. 吸氧

正确答案：D。洗胃

解析：本题考查中毒解救。加速尚未吸收毒物的排泄应予洗胃（D对）。洗胃的目的是为了清除胃内毒物，阻止毒物吸收和毒物吸附。针灸（A错）用于眼科疾病主要可以治疗急性结膜炎、白内障，对眼内污染物无效。眼内污染毒物时，必须立即用清水冲洗（B错）至少5分钟，并滴入相应的中和剂；对固体的腐蚀性毒物颗粒，要用眼科器械取出异物。利尿（C错）可加速已吸收毒物的排泄。吸氧（E错）用于吸入性中毒。